男性，65岁。陈旧性广泛前壁心肌梗死7年，活动后胸闷、心悸、气短2年，近1周出现夜间阵发性呼吸困难。体检：端坐呼吸，BP160/90mmHg，P120次/分。P₂亢进，心脏各瓣膜区未闻及杂音。双肺底可闻及细湿啰音，双肺散在哮鸣音。腹平软，肝脾肋下未触及，双下肢无水肿。空腹血糖4.2mmol/L。心电图：V₁～V₆导联ST段压低0.05～0.1mV。血清肌钙蛋白正常。该患者血压控制目标至少是
A. 160/90mmHg
B. 150/90mmHg
C. 140/90mmHg
D. 130/90mmHg
E. 130/80mmHg

正确答案：E。130/80mmHg

解析：患者老年男性，既往有活动后胸闷心悸气短，近1周出现夜间阵发性呼吸困难，端坐呼吸，P₂亢进，双肺底可闻及细湿啰音，双肺散在哮鸣音，该患者目前最可能的诊断是急性左心衰竭。血压控制一般主张目标值应＜140/90mmHg（C错），但该患者有心肌梗死病史，且伴左心衰竭，故该患者血压控制目标至少是130/80mmHg（E对ABD错），根据病情在数周至数月内将血压逐渐降至目标水平即可。